下列结构损伤可以导致双眼颞侧偏盲的是
A. 视神经
B. 视觉中枢
C. 视交叉中部
D. 视束
E. 视乳头

正确答案：C。视交叉中部

解析：视交叉正中部病变，可出现双眼颞侧偏盲(C对）｡视神经损害产生同侧视力下降或全盲(A错）｡视觉中枢病变可分为两种情况，激性病变可出现闪光､暗影､色彩等幻视现象，破坏性病变可出现视野缺损(B错）｡视束病变多引起两眼对侧视野的偏盲(同向性偏盲）(D错）｡视乳头水肿多引起周边部视野缺损及生理盲点扩大(E错）｡